引起槟榔肝的原因是
A. 酒精性肝硬化
B. 胆汁性肝硬化
C. 门脉性肝硬化
D. 慢性肝淤血
E. 坏死性肝硬化

正确答案：D。慢性肝淤血

解析：槟榔肝由慢性肝淤血（D对）引起，因肝小叶中央区的肝血窦扩张淤血呈暗红色，肝小叶周边部肝细胞则因脂肪变性呈黄色，导致肝的切面上出现红、黄相间的条纹，状似槟榔切面而得名。各种类型的肝硬化都不会引起槟榔肝。